中毒时，有中枢兴奋作用的药物是
A. 阿托品
B. 东莨菪碱
C. 山莨菪碱
D. 后马托品
E. 哌仑西平

正确答案：A。阿托品

解析：本题考查阿托品。阿托品（A对）中毒时可出现中枢兴奋的不良反应，表现为心率加快、烦躁不安、幻觉等，继而由兴奋转为抑制；东莨菪碱（B错）不良反应为中枢抑制；山莨菪碱（C错）不能通过血脑屏障，极少引起中枢兴奋；后马托品（D错）为合成抗胆碱药，一般用作扩瞳药；哌仑西平（E错）为选择性的M抗胆碱能药物，无中枢抑制作用，临床用于消化性溃疡。